片剂质量的要求是
A. 含量准确，重量差异小
B. 压制片中药物很稳定，故无保存期规定
C. 崩解时限或溶出度符合规定
D. 色泽均匀，完整光洁，硬度符合要求
E. 片剂大部分经口服用，不进行细菌学检查

正确答案：A、C、D。含量准确，重量差异小；崩解时限或溶出度符合规定；色泽均匀，完整光洁，硬度符合要求

解析：本题考查片剂的质量要求。片剂的质量要求包括：（1）硬度适中，一般认为普通片剂的硬度在50N以上为宜；（2）脆碎度反映片剂的抗磨损和抗振动能力，小于1%为合格片剂；（3）符合片重差异的要求，含量准确（A对）；（4）色泽均匀，外观光洁（D对）；（5）符合崩解度或溶出度的要求（C对）；（6）小剂量的药物或作用比较剧烈的药物，应符合含量均匀度的要求；（7）符合有关卫生学的要求（E错）；片剂有保存期规定（B错）。